未取得麻醉药品和第一类精神药品处方资格医师擅自开具麻醉药品，造成严重后果的应
A. 给予警告
B. 口头批评
C. 暂停其执业活动
D. 吊销其执业证书
E. 依法追究刑事责任

正确答案：D。吊销其执业证书

解析：未取得麻醉药品和第一类精神药品处方资格医师的法律责任　未取得麻醉药品和第一类精神药品处方资格的执业医师擅自开具麻醉药品和第一类精神药品处方，由县级以上人民政府卫生主管部门给予警告，暂停其执业活动；造成严重后果的，吊销其执业证书；构成犯罪的，依法追究刑事责任。掌握“麻醉、精神药品的使用及法律责任”知识点。